患者腹痛，下利清谷，小便不利，四肢沉重疼痛，肢体水肿，心悸，舌淡，脉细，其临床意义是
A. 附子汤证
B. 四逆汤证
C. 真武汤证
D. 黄连阿胶汤证
E. 桂枝汤证

正确答案：C。真武汤证

解析：《伤寒论·辨少阴病脉证并治》：“少阴病，二三日不已，至四五日，腹痛，小便不利，四肢沉重疼痛，自下利者，此为有水气。其人或咳，或小便利，或下利，或呕者，真武汤主之”（C对）。“少阴病，得之一二日，口中和，其背恶寒者，少阴病，身体痛，手足寒，骨节痛，脉沉者”用附子汤证治疗（A错）。“阳虚欲脱，冷汗自出，四肢厥逆，下利清谷，脉微欲绝”用四逆汤证治疗（B错）。“少阴病、得之二、三日以上，心中烦不得卧”用黄连阿胶汤证治疗（D错）。头痛发热，汗出恶风，鼻鸣干呕，苔白不渴，脉浮缓或浮弱用桂枝汤治疗（E错）。